男，50岁，中度肥胖，空腹血糖8mmol/L,餐后2小时血糖12mmol/L，胰岛素基础值50U/ml，应首选何药
A. 格列吡嗪
B. 格列齐特
C. 格列苯脲
D. 双胍类
E. 格列喹酮

正确答案：D。双胍类

解析：中年男性患者，中度肥胖，空腹血糖8mmol/L（正常值3.8~6.1mmol/L），餐后2小时血糖12mmol/L，考虑诊断为T2DM型糖尿病。双胍类（D对）是2型糖尿病的一线用药，且不增加体重。格列吡嗪（A错）、格列齐特（B错）、格列苯脲（C错）、格列喹酮（E错）属磺脲类降糖药，会引起体重增加，主要用于非超重的2型糖尿病。